在临床使用中，用作注射用无菌粉末溶剂的是
A. 注射用水
B. 矿物质水
C. 饮用水
D. 灭菌注射用水
E. 纯化水

正确答案：D。灭菌注射用水

解析：本题考查制药用水。在临床使用中，用作注射用无菌粉末溶剂的是灭菌注射用水（D对）。灭菌注射用水为注射用水按照注射剂生产工艺制备所得，不含任何添加剂。临床应用的灭菌注射用水一般按药品批准文号管理，主要用于注射用灭菌粉末的溶剂或注射剂的稀释剂。注射用水（A错）为纯化水经蒸馏所得的水，可作为注射剂、滴眼剂等的溶剂或稀释剂及容器的清洗溶剂。矿物质水（B错）一般不用做制药用水。饮用水（C错）为天然水经过纯化的得到的，一般不用做制药用水。纯化水（E错）为饮用水经蒸馏法、离子交换法、反渗透法或其它适宜方法制得的制药用水，不含任何附加剂。可作为配制普通药物制剂的溶剂或试验用水，口服、外用制剂配制用溶剂或稀释剂。纯化水不得用于注射剂的配制与稀释。